吗啡的化学结构中含有
A. 哌啶环
B. 酚羟基
C. 甲氧基
D. 环氧基
E. 两个苯环

正确答案：A、B、D。哌啶环；酚羟基；环氧基

解析：本题考查吗啡。吗啡的化学结构中含有哌啶环（A对）、酚羟基（B对）、环氧基（D对）。从吗啡的结构式可以看出，吗啡是吗啡的化学结构中含有是由5个环（A、B、C、D、E）稠合而成的复杂结构，含有部分氢化的菲环（E错）。其中，D环中含有环氧基，甲基与17位N原子相连，不含有甲氧基（C错），E环为哌啶环，吗啡结构的3位是具有弱酸性的酚羟基。